正常肺泡呼吸音的最明显听诊部位在
A. 喉部
B. 肩胛下部
C. 胸骨角附近
D. 右肺尖
E. 肩胛上部

正确答案：B。肩胛下部

解析：正常肺泡呼吸音的最明显听诊部位在肩胛下部（B对）或乳房下部，其次为腋窝下部，而肺尖（D错）及肺下缘区域则较弱。喉部（A错）、胸骨角附近（C错）、肩胛上部（E错）不能听及肺泡呼吸音。